具有镇咳作用的是
A. 苦杏仁苷
B. 野樱苷
C. 二者皆可
D. 二者皆不可

正确答案：C。二者皆可

解析：本题考查的是苦杏仁苷的药理作用。具有镇咳作用的是苦杏仁苷与野樱苷（C对）。苦杏仁苷的代谢转化途径：苦杏仁苷（A错）既是苦杏仁止咳祛痰的药效物质基础，又是其毒性产生的主要原因，过量服用有毒。口服苦杏仁苷后，该药经肠道菌群的β-糖苷酶催化发生水解反应，双糖苷首先转化成单糖苷野樱苷（B错），再经酶催化水解成苷元，分解释放出少量氢氰酸（HCN）而产生止咳祛痰作用，由于肠道菌群富含高活性的β-糖苷酶，催化活性比较高，因此，苦杏仁的口服剂量是临床使用的关键点，应严格控制，避免过量产生毒性反应。